燥邪伤人引发的主要症状有
A. 口鼻干燥
B. 皮肤干涩
C. 毛发不荣
D. 干咳少痰
E. 痰黏难咯

正确答案：A、B、C、D、E。口鼻干燥；皮肤干涩；毛发不荣；干咳少痰；痰黏难咯

解析：本题考查的是燥邪的性质及治病特点。燥邪伤人引发的主要症状有燥口鼻干燥（A对）、皮肤干涩（B对）、毛发不荣（C对）、干咳少痰（D对）与痰黏难咯（E对）。燥邪的性质及致病特点。（1）燥性干涩，易伤津液：燥邪最易耗伤人体的津液，造成阴津亏虚的病变，常见口鼻干燥、咽干口渴、皮肤干涩，甚则皲裂、毛发不荣、小便短少、大便干结等。（2）燥易伤肺：肺为娇脏，喜润而恶燥，所以既不耐寒温，更不耐干燥。肺主呼吸，与外界大气相通，外合皮毛，开窍于鼻，所以燥邪伤人，多从口鼻而入，故最易伤损肺津，影响肺的宣发与肃降功能，出现干咳少痰，或痰液胶黏难咳，或痰中带血，以及喘息胸痛等证。